患者男，31岁，有冠心病史5年。现症见全身水肿，下肢重，喘促气短，形寒肢冷，腰膝酸软，心悸胸闷，小便短少舌淡苔白，脉沉细查体：颈静脉怒张，肝大压痛，肝颈静脉回流征阳性，双下肢凹陷性水肿。诊断为“冠心病，心衰”，其症候是
A. 心肾阳虚，水湿泛滥
B. 心肾阳虚，虚阳外越证
C. 心肺气虚，痰瘀痹阻证
D. 心肺气虚，虚阳外越证
E. 心肾阳虚，痰饮上逆证

正确答案：A。心肾阳虚，水湿泛滥

解析：患者男，31岁，有冠心病史5年（有基础病病史），肾阳亏虚，蒸腾气化失司，三焦决渎不利，水湿内停，外溢肌肤，故见全身水肿，下肢重，小便短少；心阳虚衰，宗气衰少，胸阳不展，故见喘促气短；阳虚形体失于温养，脏腑功能衰退，故见形寒肢冷，腰膝酸软；心肾阳虚，鼓动无力，故见心悸胸闷；心肾阳虚，水湿泛滥，故见舌淡苔白，脉沉细。查体：颈静脉怒张，肝大压痛，肝颈静脉回流征阳性，双下肢凹陷性水肿（为右心衰竭体征，以体循环静脉淤血的表现为主）（A对）。心力衰竭心肾阳虚，虚阳外越证的主要临床表现是喘促日久，呼多吸少，面赤躁扰，汗出如注（B错）。心力衰竭心肺气虚，痰瘀痹阻证的主要临床表现是胸痛胸闷，脘痞纳呆，肢体沉重，舌暗苔腻（C错）。心力衰竭心肺气虚，虚阳外越证的主要临床表现是四肢厥冷，面色苍白，冷汗淋漓，气息微弱，脉微欲绝（D错）。心肾阳虚，痰饮上逆证的主要临床表现是喘促气逆，不能平卧，痰稀量多，形寒肢冷（E错）。